肺之志为
A. 忧
B. 喜
C. 怒
D. 思
E. 恐

正确答案：A。忧

解析：忧、悲由肺精、肺气化生，故说肺在志为悲（忧）（A对）。心在志为喜（B错）。肝在志为怒（C错）。脾在志为思（D错）。肾在志为恐（E错）。